以下是环境毒理学研究的基本内容和任务，哪项除外
A. 未知毒性化合物基本毒理学特征评价
B. 建立动物模型，确定病因
C. 毒作用机制和生物标志研究
D. 应用于环境生物监测
E. 确证对人类的致癌性

正确答案：E。确证对人类的致癌性

解析：本题考查环境毒理学研究的基本内容和任务。环境毒理学研究的基本内容和任务包括：未知毒性化合物基本毒理学特征评价（A对）；建立动物模型，确定病因（B对）；毒作用机制和生物标志研究（C对）；应用于环境生物监测（D对）。确证对人类的致癌性（E错，为本题正确答案）不是环境毒理学研究的基本内容和任务。